雷公藤中毒，严重者主要表现为
A. 出现各种出血症状，严重脱水，低蛋白血症
B. 呼吸麻痹，昏迷惊厥，瞳孔散大，对光反射消失
C. 急性肾功能衰竭，粒细胞减少，再生障碍性贫血
D. 呼吸浅表不规则，面色苍白发绀，瞳孔极度缩小呈针尖样
E. 四肢麻木，谵妄，痉挛，脑水肿，意识障碍，精神错乱

正确答案：C。急性肾功能衰竭，粒细胞减少，再生障碍性贫血

解析：本题考查的是中药饮片的不良反应。雷公藤中毒，严重者主要表现为急性肾功能衰竭，粒细胞减少，再生障碍性贫血（C对）。雷公藤的不良反应表现：①消化系统：腹痛、腹泻，恶心、呕吐，食欲不振，肝损害，少数可致伪膜性肠炎，严重者可致消化道出血。②血液系统：血小板、白细胞、血红蛋白减少，严重者可发生急性粒细胞减少、再生障碍性贫血等。③生殖系统：对男性患者雷公藤可抑制精细胞中酶的活性，导致精子产生和成熟发生障碍，表现为精子数量显著减少，长期用药还会导致性欲减退、睾丸萎缩；对女性患者雷公藤可抑制其卵巢功能，表现为月经紊乱、经量减少、卵巢早衰。④神经系统：头晕、乏力、失眠、听力减退、嗜睡、复视，还可引起周围神经炎。⑤泌尿系统：主要表现为急性肾功能衰竭，服药后迅速出现或逐渐发生少尿、水肿、血尿、蛋白尿、管型尿、腰痛或伴肾区叩击痛，常常发生于过量中毒时。⑥心血管系统：心悸、胸闷、心动过缓、气短、心律失常、心电图改变（ST-T改变），严重者可见血压急剧下降，个别出现室颤、心源性休克而死亡。⑦皮肤黏膜损害：皮肤糜烂、溃疡、斑丘疹、荨麻疹、瘙痒等。出现各种出血症状，严重脱水，低蛋白血症（A错）是蓖麻子的不良反应表现。蓖麻子的不良反应表现：蓖麻毒素经呼吸道吸入、消化道摄入和肌内注射均可致人中毒，潜伏期一般为4～8小时，临床主要表现如下。①消化系统：口麻、咽部烧灼感、恶心、呕吐、腹痛、腹泻、出血性胃肠炎，黄疸以及中毒性肝病等。②呼吸、循环系统：呼吸、循环衰竭。③网状内皮系统：严重脱水、低蛋白血症、水肿、毒血症、高热。④血液、泌尿系统：溶血；血便、血尿、少尿、尿闭等中毒性肾病。⑤神经系统：四肢麻木、步态不稳、烦躁不安、精神错乱、手舞足蹈、昏迷、幻觉、癫痫样发作。⑥有时可伴发过敏反应如口唇青紫、荨麻疹。呼吸麻痹，昏迷惊厥，瞳孔散大，对光反射消失（B错）是苦杏仁的不良反应表现。苦杏仁不良反应表现：苦杏仁的主要成分苦杏仁苷是其有效成分也是中毒成分，误服过量苦杏仁可发生氢氰酸中毒，使延髓等生命中枢先抑制后麻痹，并抑制细胞色素氧化酶的活性而引起组织窒息。临床表现为眩晕、心悸、恶心、呕吐等中毒反应，重者出现昏迷、惊厥、瞳孔散大、对光反应消失，最后因呼吸麻痹而死亡。呼吸浅表不规则，面色苍白发绀，瞳孔极度缩小呈针尖样（D错）为罂粟壳的不良反应表现。罂粟壳的不良反应表现：罂粟壳中含有的主要成分是吗啡、可待因、罂粟碱等，罂粟壳中毒与其所含的主要成分吗啡有关。其临床表现为昏睡或昏迷，抽搐，呼吸浅表而不规则，恶心、呕吐、腹泻，面色苍白，发绀、瞳孔极度缩小呈针尖样，血压下降等。目前文献报道的病例报告中，罂粟碱中毒均体现在婴幼儿中，可能因为婴儿中枢神经系统、肝、肾、酶系统等发育未成熟，对中药较敏感，易引起中毒。四肢麻木，谵妄，痉挛，脑水肿，意识障碍，精神错乱（E错）是胆矾的不良反应表现。胆矾的不良反应表现：①消化系统：流涎、恶心、呕吐、腹痛、腹泻、呕血、便血等，口涎、呕吐物、粪便多呈蓝绿色，口中有特殊金属味；黄疸、中毒性肝炎等症状。②血液系统：溶血性贫血。③泌尿系统：蛋白尿、血尿、少尿、无尿、氮质血症、急性肾功能衰竭或尿毒症等。④循环系统：血管麻痹、血压下降。铜离子对心脏损害可引起中毒性心肌炎，表现心动过速、心律失常及心力衰竭。⑤神经系统：头痛头晕、全身乏力，严重者出现脑水肿、痉挛、神经麻痹、谵妄、意识障碍等中毒性脑炎症状。